根管治疗的适应证，除外
A. 根管闭锁的根尖周炎
B. 不可复性牙髓炎
C. 各型根尖周炎
D. 乳牙根尖周炎
E. 牙髓牙周联合征

正确答案：A。根管闭锁的根尖周炎

解析：根管治疗要求的是根管畅通能达到根尖，闭锁根管不属于适应证。根管治疗适应证：①牙髓疾病：不能保存活髓的各型牙髓炎；牙髓坏死；牙内吸收；牙髓钙化，仅指可以除去髓腔内的钙化物，根管通畅达根尖部者；②各型根尖周病：急性根尖周炎须在急性症状缓解后再行根管治疗；③牙髓牙周联合病：与牙髓感染有关的牙周病变，成功的根管治疗有助于牙周病变的控制；④因特殊需要摘除牙髓的患牙：外伤或其他原因致牙体缺损过大，修复时需要去除牙髓；过长牙，修复需要大量调低咬合，可能累及牙髓；其他因牙体修复或其他治疗需要摘除牙髓的病例；⑤牙根尖周外科手术的需要：牙根周围的囊性或瘤性病变手术切除可波及牙髓的病例，术前应先做根管治疗。掌握“根管治疗术概述”知识点。